急性有机磷农药中毒的主要临床表现包括
A. 呼吸道分泌物增加、肺水肿、瞳孔缩小
B. 全身紧束感、胸部压迫感、肌束震颤
C. 消化系统症状、眼睛的症状、呼吸道症状
D. 毒蕈碱样症状、中枢神经系统症状、烟碱样症状
E. 毒蕈碱样症状、消化系统症状、烟碱样症状

正确答案：D。毒蕈碱样症状、中枢神经系统症状、烟碱样症状

解析：本题考查急性有机磷中毒的临床表现。本题考查有机磷农药急性中毒症状。当有机磷急性中毒时，会出现以下症状：（1）毒蕈碱样症状（M样症状），早期就可出现，主要表现为腺体分泌亢进、平滑肌痉挛、瞳孔缩小、心血管抑制；（2）烟碱样症状（N样症状），血压升高及心动过速。运动神经兴奋时，表现肌束震颤、肌肉痉挛，进而由兴奋转为抑制，出现肌无力、肌肉麻痹等；（3）中枢神经系统（D对ABCE错）症状，早期出现头晕、头痛、倦怠、乏力等，随后可出现烦躁不安、言语不清及不同程度的意识障碍；（4）其他症状。